在霍乱的临床表现中哪项是错误的
A. 寒战、高热、急性起病
B. 先泻后吐
C. 无病性腹泻
D. "米泔水"样吐泻物
E. 严重者有痛性肌肉痉挛

正确答案：A。寒战、高热、急性起病

解析：典型霍乱的病程可分为3期，泻吐期一般无发热，因此寒战、高热、急性起病（A错，为本题正确答案）错误；表现为先泻后吐（B对），无痛性腹泻（C对）是发病的第一个症状，亦无里急后重。起初大便含粪质，后为黄色水样便或米泔水样便。呕吐一般发生在腹泻后，多为喷射状，呕吐物为米泔水样液体（D对）。大量泻呕使钠盐大量丢失出现低钠血症，可引起腓肠肌和腹直肌痉挛等有痛性肌肉痉挛（E对），临床表现为痉挛部位的疼痛，肌肉呈强直状态。